在评价影响内在真实性的历史性因素中可通过下列哪种方法排除
A. 加强工作人员的技术培训
B. 多次基线测量
C. 设立对照组或过程追踪
D. 测量工具的校正
E. 其他方法

正确答案：C。设立对照组或过程追踪